对偶三角瓣主要适应于
A. 整复邻近组织缺损
B. 松解条索状瘢痕挛缩
C. 覆盖感染创面
D. 毛发移植
E. 器官再造

正确答案：B。松解条索状瘢痕挛缩

解析：本题考查对偶三角瓣的应用。对偶三角瓣又名移位皮瓣或Z成形术。是由皮肤三个切口连接成Z形而构成两个相对的三角形皮瓣彼此交换位置后缝合。其主要作用是两瓣交叉缝合后能延长组织，多应用于松解条索状瘢痕挛缩（B对）；也可用于恢复错位的组织或器官的正常位置与功能；以及用于长切口的闭合以预防术后瘢痕挛缩。整复邻近组织缺损（A错）主要是用推进、旋转皮瓣或皮管、游离皮瓣等修复。表层皮片的抗感染能力强，容易成活，感染创面（C错）只能用表层皮片。全厚皮片因含有毛囊，移植后毛发可以再生，所以毛发移植（D错）用全厚皮片，器官再造（E错）如眉再造等用的也是全厚皮片。